胫骨中下1/3交界处易骨折，其主要原因是
A. 胫骨形状有棱角
B. 负重量较大
C. 位于皮下软组织少
D. 易受直接或间接暴力
E. 骨的形态转变移行处

正确答案：E。骨的形态转变移行处

解析：胫骨干横切面呈三棱形，在中、下1/3交界处，变成四边形。三棱形和四边形交界处为骨的形态转变移行处（E对），为胫骨中下1/3交界处易骨折的主要原因。而胫骨负重量较大（B错）、位于皮下软组织少（C错）为胫骨易受直接或间接暴力损伤原因，直接或间接暴力（D错）可致胫骨骨折，但不是胫骨中下1/3交界处易骨折的主要原因。胫骨形状有棱角（A错）可作为骨折后手法复位的标志，而不是胫骨中下1/3交界处易骨折的主要原因。